下述皮肤区的神经分布哪个是错误的
A. 胸骨角平面为第二胸神经分布带
B. 胸骨剑突处为第六胸神经分布带
C. 脐平面为第十胸神经分布带
D. 腹股沟区为第一腰神经分布带
E. 男性乳头平面为第三胸神经分布带

正确答案：E。男性乳头平面为第三胸神经分布带

解析：男性乳头平面为第四胸神经分布带（E错，为本题正确选项）。